外源化合物生物转化酶所催化的Ⅰ相反应不包括
A. 水解反应
B. 甲基化反应
C. 还原反应
D. 氧化反应

正确答案：B。甲基化反应

解析：本题考查Ⅰ相反应。外源化合物生物转化酶所催化的Ⅰ相反应包括氧化反应（D对）、还原反应（C对）和水解反应（A对）。甲基化反应（B错，为本题正确答案）属于Ⅱ相反应。